患者，女，30岁，已婚。月经25天一行，经来量多，色深红，质稠，有血块，口渴心烦。治疗应首选
A. 安冲汤
B. 保阴煎
C. 两地汤
D. 解毒四物汤
E. 清热固经汤

正确答案：B。保阴煎

解析：题中患者月经25天一行，经来量多，故诊断为月经过多。经来量多为热盛于里，扰乱冲任、血海，乘经行之际，迫血下行所致，热灼血液，故经色深红，质稠，血热瘀滞，经行不畅，故有血块，热邪扰心，故心烦，热邪伤津，故口渴，故辨为血热证，治宜清热凉血，固冲止血。安冲汤功能补气升提，固涩安冲，可用于治疗月经过多气虚证（A错）。保阴煎功能清热凉血，固冲止血，为月经过多血热证的首选方（B对）。两地汤功能滋阴清热，为月经先期阴虚血热证的选方（C错）。解毒四物汤功能养血解毒，清肠止血，主治血虚火旺，大便下血证（D错）。清热固经汤功能滋阴清热，固经止血，为崩漏血热证之实热证的选方（E错）。